含氢氯噻嗪的是
A. 冠通片
B. 新癀片
C. 脂降宁片
D. 脉络通胶囊
E. 珍菊降压片

正确答案：E。珍菊降压片

解析：本题考查的是含西药组分的中成药。含氢氯噻嗪的是珍菊降压片（E对）。珍菊降压片：功能降压。用于高血压。含西药成分盐酸可乐定、氢氯噻嗪。冠通片（A错）：增加冠状动脉血流量，降低冠状动脉阻力，减少心肌耗氧量，并有降低血压的作用。用于冠状动脉粥样硬化、心肌梗死、心绞痛及高血压等。含西药成分维生素C、异去氧胆酸。新癀片（B错）：功能清热解毒，活血化瘀，消肿止痛。用于热毒瘀血所致的咽喉肿痛、牙痛、痹痛、胁痛、黄疸、无名肿毒。含西药成分吲哚美辛。脂降宁片（C错）：功能行气散瘀，活血通络，益精血，降血脂。用于胸痹心痛、眩晕耳鸣、肢体麻木、高脂血症或合并高血压、冠心病、动脉硬化等高脂血症。含西药成分维生素C、氯贝酸铝。脉络通胶囊（D错）：功能益气活血，化瘀止痛。用于气虚血瘀所致的胸痹，症见心胸疼痛、胸闷气短、头痛眩晕；冠心病心绞痛见上述证候及中风所致的肢体麻木、半身不遂。含西药成分维生素C、碳酸氢钠。